有关静脉注射脂肪乳剂的正确表述有
A. 要求80%微粒的直径＜1μm
B. 是一种常用的血浆代用品
C. 可以使用聚山梨酯80作为乳化剂
D. 可以使用普朗尼克F68作为乳化剂
E. 不产生降压作用和溶血作用

正确答案：D、E。可以使用普朗尼克F68作为乳化剂；不产生降压作用和溶血作用

解析：本题考查注射剂常用附加剂。注射用乳剂除应符合注射剂各项规定外，还必须符合下列条件：①静脉用乳状液型注射液中90%的乳滴粒径应在1μm以下（A错），不得有大于5μm的乳滴。②成品耐受高压灭菌，在贮存期内乳剂稳定，成分不变。③无副作用，无抗原性，无降压作用与溶血作用（E对）。乳化剂常用的有卵磷脂、豆磷脂及普朗尼克F-68等（D对C错）。静脉注射用脂肪乳剂不可以用作血浆代用品（B错）。